空肠和回肠
A. 空肠管径较细
B. 回肠管壁较厚
C. 空肠血管弓较多
D. 回肠黏膜皱襞疏、高
E. 空肠无集合淋巴滤泡

正确答案：E。空肠无集合淋巴滤泡

解析：空肠管径较粗(A错)，回肠管壁较薄(B错)，空肠血管弓较少(C错)，回肠和空肠黏膜皱襞密集(D错)，空肠内有孤立淋巴滤泡，无集合淋巴滤泡(E对)。